关于介水传染病的流行特点错误的是
A. 水源一次严重污染后，可呈暴发流行
B. 多数患者发病日期集中在同一潜伏期内
C. 病例分布与供水范围一致
D. 若水源经常受污染，发病者可终年不断
E. 对污染源采取消毒措施后，疾病的流行仍难以得到控制

正确答案：E。对污染源采取消毒措施后，疾病的流行仍难以得到控制

解析：本题考查介水传染病的流行特点。介水传染病指通过饮用或接触受病原体污染的水而传播的疾病。其流行特点为：①水源一次严重污染后，可呈暴发流行（A对），短期内突然出现大量病人，且多数患者发病日期集中在同一潜伏期内（B对）。若水源经常受污染，则发病者可终年不断（D对），病例呈散发流行；②病例分布与供水范围一致（C对）。大多数患者都有饮用或接触同一水源的历史；③一旦对污染源采取治理措施，并加强饮用水的净化和消毒后，疾病的流行能迅速得到控制（E错，为本题正确答案）。